以下哪种情况需行系带矫正术
A. 系带位置影响牙齿萌出排列
B. 舌系带过短影响发音
C. 唇系带过短影响唇的运动
D. 系带影响义齿的就位和稳定
E. 以上均需要

正确答案：E。以上均需要

解析：唇、颊及舌系带如发生形态、位置及数目异常，影响唇、舌的运动，以致发生哺乳、咀嚼、发音等功能障碍；影响牙齿萌出排列；影响义齿的就位和稳定，常需手术矫正。掌握“牙槽外科”知识点。